咳嗽属于外感风热者，宜选用的成药是
A. 急支糖浆
B. 小青龙合剂
C. 养阴清肺膏
D. 苏子降气丸
E. 蛇胆川贝散

正确答案：A。急支糖浆

解析：本题考查的是急支糖浆的主治。咳嗽属于外感风热者，宜选用的成药是急支糖浆（A对）。急支糖浆：【主治】外感风热所致的咳嗽，症见发热、恶寒、胸膈满闷、咳嗽咽痛；急性支气管炎、慢性支气管炎急性发作见上述证候者。小青龙合剂（B错）：【主治】风寒水饮，恶寒发热、无汗、喘咳痰稀。养阴清肺膏（C错）：【主治】阴虚燥咳，咽喉干痛，干咳少痰，或痰中带血。苏子降气丸（D错）：【主治】上盛下虚、气逆痰壅所致的咳嗽喘息、胸膈满闷。蛇胆川贝散（E错）：【主治】肺热咳嗽，痰多。